感冒时，不宜自行选择用药的患者有
A. 暑湿感冒者
B. 儿童感冒者
C. 体虚反复感冒者
D. 流行性感冒者
E. 感冒病程中出现并发症者

正确答案：B、C、E。儿童感冒者；体虚反复感冒者；感冒病程中出现并发症者